属于血小板膜蛋白Ⅱb/Ⅲa受体阻断剂的是
A. 阿司匹林
B. 氯吡格雷
C. 替罗非班
D. 奥扎格雷
E. 前列环素

正确答案：C。替罗非班

解析：本题考查血小板膜蛋白Ⅱb/Ⅲa受体阻断剂。替罗非班（C对）为高选择性非肽类血小板膜糖蛋白Ⅱb/Ⅲa受体阻断剂，可减少血栓负荷和继发的远端微循环栓塞，改善心肌组织水平的灌注。阿司匹林（A错）为环氧酶抑制剂。氯吡格雷（B错）为二磷酸腺苷P2Y12受体阻断剂，可抑制血小板聚集。奥扎格雷钠（D错）为血栓烷合成酶抑制剂，可选择性抑制血栓烷合成酶。前列环素（E错）为血小板腺苷环化酶刺激剂，可抑制血小板的聚集。